在某个时间内能检查的整个人群样本中，某病现有感染者人数所占的比例
A. 感染率
B. 续发率
C. 引入率
D. 超额死亡率
E. 累积死亡率

正确答案：A。感染率

解析：本题考查感染率的概念。感染率（A对BCDE错）是指在某时间内被检人群中某病原体现有感染者人数所占的比例，通常用百分率表示。